对发生医疗事故的有关医务人员，除依照前款处罚外，卫生行政部门并可以责令
A. 暂停3个月以上6个月以下
B. 暂停5个月以上1年以下
C. 暂停6个月以上1年以下
D. 暂停8个月以上2年以下
E. 暂停10个月以上2年以下

正确答案：C。暂停6个月以上1年以下

解析：对发生医疗事故的有关医务人员，除依照前款处罚外，卫生行政部门并可以责令暂停6个月以上1年以下执业活动；情节严重的，吊销其执业证书。掌握“医疗事故行政处理、监督与法律责任”知识点。